小剂量地塞米松抑制试验适用于
A. 肾上腺皮质功能减退症定性
B. 肾上腺皮质增多症定性
C. 肾上腺皮质增多症定位
D. 肾上腺皮质功能减退症定位
E. 醛固酮增多症定性

正确答案：B。肾上腺皮质增多症定性

解析：小剂量地塞米松抑制试验适用于肾上腺皮质增多症定性（B对），主要用于鉴别单纯性肥胖与Cushing综合征。适用于肾上腺皮质功能减退症定性（A错）的是ACTH兴奋试验，主要用于鉴别Cushing病与异位ACTH综合征和肾上腺皮质腺瘤。适用于肾上腺皮质增多症定位（C错）的是大剂量地塞米松抑制试验和CRH兴奋试验，主要用于鉴别Cushing病与非垂体性库欣综合征。适用于肾上腺皮质功能减退症定位（D错）的是ACTH兴奋试验和影像学检查。适用于醛固酮增多症定性（E错）的是血、尿生化检查和醛固酮测定。